畜肉处在僵直和后熟过程中为
A. 腐败肉
B. 条件可食肉
C. 废弃肉
D. 新鲜肉
E. 病畜肉

正确答案：D。新鲜肉